某男，57岁。患高血压病10年，近发湿疹瘙痒。宜选用的药是
A. 木瓜
B. 伸筋草
C. 丝瓜络
D. 豨莶草
E. 乌梢蛇

正确答案：D。豨莶草

解析：本题考查的是豨莶草的主治病证。高血压病10年，近发湿疹瘙痒。宜选用的药是豨莶草（D对）。豨莶草：【主治病证】（1）风湿痹痛，肢体麻木。（2）中风手足不遂。（3）痈肿疮毒，湿疹瘙痒。（4）高血压病。木瓜（A错）：【主治病证】（1）风湿痹痛，筋脉拘挛，脚气肿痛。（2）湿浊中阻所致吐泻转筋。（3）津亏食少（消化不良）证。伸筋草（B错）：【主治病证】（1）风湿痹痛，关节酸痛，屈伸不利。（2）跌打损伤。丝瓜络（C错）：【主治病证】（1）风湿痹痛，拘挛麻木。（2）咳嗽胸痛，胸痹疼痛，肝郁胸胁胀痛。（3）乳痈肿痛，疮肿。乌梢蛇（E错）：【主治病证】（1）风湿痹痛，筋脉拘挛。（2）中风半身不遂，口眼㖞斜，肢体麻木。（3）破伤风，急慢惊风。（4）麻风，顽癣，皮肤瘙痒。